男，16岁。发热、干咳3天，最高体温37.8℃，N0.75。胸部X线片示右下肺纹理增粗、模糊。首选药物
A. 头孢拉啶
B. 阿奇霉素
C. 左氧氟沙星
D. 阿米卡星
E. 青霉素

正确答案：B。阿奇霉素

解析：该患者为青少年男性，发热、干咳3天，最高体温38℃（正常值36℃～37℃）为低热，中性粒细胞比值0.75（正常值0.40～0.75），胸部X线片示右下肺纹理增粗、模糊（为肺炎支原体肺炎的典型表现），根据其临床表现和辅助检查，不难诊断出患者为肺炎支原体肺炎，治疗首选大环内酯类抗生素如阿奇霉素（B对）等。大环内酯类药物不敏感者可选用左氧氟沙星（C错）。青霉素（E错）或头孢拉啶（A错）等抗生素是抑制细菌细胞壁的合成来发挥作用，支原体无细胞壁，故此类药物对支原体肺炎无效。阿米卡星（D错）属于氨基糖苷类抗生素，有耳毒性的副作用，且抗菌谱不包括肺炎支原体，故不作首选。